培养真菌的最适宜温度是
A. 4～9℃
B. 10～15℃
C. 16～21℃
D. 22～28℃
E. 29～37℃

正确答案：D。22～28℃

解析：真菌对营养的要求不高，常用沙氏葡萄糖琼脂培养基。温度为22～28℃；但某些深部真菌最适生长温度为37℃；最适pH值为4.0～6.0。掌握“真菌概述及主要病原性真菌”知识点。